关于药品广告审查的说法，错误的是
A. 在广播电台上发布含有药品名称、药品适应症的广告应按药品广告进行审查
B. 非处方药仅宣传药品名称（含药品通用名称和药品商品名称）的无需审查
C. 处方药在指定的医学药学专业刊物上仅宣传药品名称（含药品通用名称和药品商品名称）的，需经发布地药品广告审查机关进行审查
D. 申请进口药品广告批准文号，应由进口药品代理机构所在地的药品广告审查机关进行审查

正确答案：C。处方药在指定的医学药学专业刊物上仅宣传药品名称（含药品通用名称和药品商品名称）的，需经发布地药品广告审查机关进行审查

解析：本题考查药品广告的界定和管理规定。药品、医疗器械、保健食品和特殊医学用途配方食品广告中只宣传产品名称（含药品通用名称和药品商品名称）的，不再对其内容进行审查（C错，为本题正确答案）。为加强药品、医疗器械、保健食品和特殊医学用途配方食品广告监督管理，规范广告审查工作，维护广告市场秩序，保护消费者合法权益，根据《广告法》等法律、行政法规，制定《药品、医疗器械、保健、特殊医学用途配方食品广告审查管理暂行办法》。药品、医疗器械、保健食品和特殊医学用途配方食品广告应当真实、合法，不得含有虚假或者引人误解的内容。广告主应当对药品、医疗器械、保健食品和特殊医学用途配方食品广告内容的真实性和合法性负责。管理范围包括药品、医疗器械、保健食品和特殊医学用途配方食品广告的审查。未经审查不得发布药品、医疗器械、保健食品和特殊医学用途配方食品广告（A对）。药品、医疗器械、保健食品和特殊医学用途配方食品广告中只宣传产品名称（含药品通用名称和药品商品名称）的，不再对其内容进行审查（B对）。发布进口药品广告，应当依照前款规定向进口药品代理机构所在地省、自治区、直辖市人民政府药品监督管理部门申请药品广告批准文号（D对）。